苍术不具有的功效是
A. 燥湿健脾
B. 祛风湿
C. 明目
D. 消积
E. 发汗

正确答案：D。消积

解析：本题考查的是苍术的功效。苍术不具有的功效是消积（D错，为本题正确答案）。苍术：【功效】燥湿健脾（A对），祛风湿（B对），发汗（E对），明目（C对）。消积为厚朴的功效。厚朴：【功效】燥湿，行气，消积，平喘。